根据传染病学防治法，属于乙类传染病学的是
A. 流行性感冒
B. 流行性腮腺炎
C. 鼠疫
D. 麻风病
E. 百日咳

正确答案：E。百日咳

解析：根据传染病学防治法，属于乙类传染病学的是百日咳（E对）。流行性感冒是丙类传染病（A错）。流行性腮腺炎丙类传染病（B错）。鼠疫是甲类传染病（C错）。麻风病是丙类传染病（D错）。